1967年，Tolonen对粘纤厂接触CS₂的333名工人及造纸厂333名无CS₂接触的工人进行调查并随访5年，其中接触CS₂工人中心肌梗塞发生25例，无CS₂接触工人有7例发生心肌梗死。该研究为
A. 现况研究
B. 病例对照研究
C. 队列研究
D. 类实验
E. 流行病学实验

正确答案：C。队列研究

解析：本题考查队列研究的概念。队列研究（C对ABDE错）是将人群按是否暴露于某可疑因素及其暴露程度分为不同组，追踪其各组的结局，比较不同组之间结局频率的差异，从而判定暴露因素与结局之间有无因果关联及关联大小的一种观察性研究方法。